男，20岁。1型糖尿病病史10年，平时每日4次胰岛素强化治疗。近2日发热，咽痛，食欲不佳，进食少，自行停用胰岛素。晨起家属发现患者不能正确回答问题，急诊就诊，查体：T38.5°C，精神差，轻度脱水貌。实验室检查：血钠140mmol/L，血钾4.5mmol/L，血糖25mmol/L，血pH7.25，尿酮体（＋＋＋）。目前该患者合理的胰岛素使用方案是
A. 恢复4次胰岛素皮下注射治疗
B. 静脉大剂量短效胰岛素治疗
C. 皮下胰岛素泵治疗
D. 静脉小剂量短效胰岛素治疗
E. 使用基础胰岛素皮下注射治疗

正确答案：D。静脉小剂量短效胰岛素治疗

解析：1型糖尿病患者（有自发DKA倾向），平时每日4次胰岛素强化治疗。近2日发热，咽痛，食欲不佳，进食少，自行停用胰岛素。晨起家属发现患者不能正确回答问题，精神差，轻度脱水貌。血糖16.7-33.3mmol/L、酸中毒、尿酮体（＋＋＋）（DKA典型表现）。该患者最可能的诊断为DKA。目前该患者合理的胰岛素使用方案是静脉小剂量短效胰岛素治疗（D对B错），通常将短效胰岛素加入生理盐水中持续静脉滴注（应另建输液途径），亦可间歇静脉注射，病情稳定后过渡到胰岛素常规皮下注射（ACE错）。